患者，女，20岁，未婚。月经淋沥20日不止，色淡红，质清稀，面色晦黯，头晕耳鸣，腰腿酸软，倦怠乏力，舌淡黯，苔白润，脉沉弱。治疗应首选
A. 八珍汤
B. 归脾汤
C. 加减苁蓉菟丝子丸
D. 右归丸
E. 加减一阴煎

正确答案：C。加减苁蓉菟丝子丸

解析：该患者月经淋沥20日不止，故诊断为崩漏。患者20岁，肾气未盛，封藏失司，冲任不固，不能制约经血，故月经淋沥20日不止，色淡红，质清稀；肾气虚，肾精不足，故头晕耳鸣，腰腿酸软，倦怠乏力；舌淡黯，苔白润，脉沉弱均为肾气虚之象，故辨为肾气虚证，治宜补肾益气，固冲止血。八珍汤功能益气补血，主治气血两虚证（A错）。归脾汤功能益气补血，健脾养心，主治心脾气虚两虚证及脾不统血证（B错）。崩漏肾气虚证治宜补肾益气，固冲止血，方选加减苁蓉菟丝子丸（C对）。右归丸功能温补肾阳，填精益髓，为崩漏肾阳虚证的选方（D错）。加减一阴煎功能滋阴清热，润肺止咳，主治阴虚发热证（E错）。